创伤性牙隐裂治疗上应首先
A. 开髓失活
B. 全冠修复
C. 备洞充填
D. 调整咬合
E. 拔除患牙

正确答案：D。调整咬合

解析：本题考查牙隐裂的治疗。创伤性牙隐裂治疗上应首先调整咬合（D对）。牙隐裂的治疗：1.消除创伤（牙合）：高陡的牙尖、锐利的边缘嵴是长期的不均匀磨损所致。这种牙齿即使在正常的咀嚼过程中也会受到较大的水平向分力，极易造成牙齿的折裂，也容易造成软组织的咬伤。由这种牙齿形成的关系称为创伤（牙合）。检查发现后，应调磨加以消除。这既是对已发生隐裂牙的治疗，也是预防其他牙齿发生隐裂的措施。2.根据症状估计隐裂线的深度，并根据深度进行处理。（1）浅：裂纹在釉牙本质界内，如果着色浅而无继发龋损者，用酸蚀法和牙釉质粘接剂光固化处理即可。（2）中：裂纹达牙本质浅层、中层。往往着色深，已有继发龋。这种情况可以沿裂纹备洞，磨除裂纹后用自酸蚀粘接技术直接粘接复合树脂。（3）深：裂纹到达牙本质深层，可能累及牙髓。这种情况应做牙髓治疗，治疗前应先行降（牙合），治疗期间可做带环保护，治疗完成后要及时进行冠修复。3.平衡咬合力。